以下关于癌症与营养的关系描述错误的是
A. 能量摄入过多、超重、肥胖者罹患乳腺癌、结肠癌、胰腺癌、子宫内膜癌和前列腺癌的概率高
B. 低蛋白质摄入与食管癌、胃癌的发生相关
C. 脂肪的摄入量与结肠癌、直肠癌、乳腺癌的发生呈负相关
D. 高淀粉摄入人群胃癌和食管癌发病率较高
E. 高钙、高维生素D膳食与结肠癌发病呈负相关

正确答案：C。脂肪的摄入量与结肠癌、直肠癌、乳腺癌的发生呈负相关